PM2.5是指直径
A. ＜2.5μm的颗粒物
B. 2.5～10μm的颗粒物
C. 2.5～5μm的颗粒物
D. '=2.5μm的颗粒物
E. ≤2.5μm的颗粒物

正确答案：E。≤2.5μm的颗粒物

解析：本题考查PM₂.₅。PM₂.₅是指空气动力学直径≤2.5μm的细颗粒（E对ABCD错）。